具有泻火凉血活血祛瘀清泻湿热功效的药物是
A. 栀子
B. 牡丹皮
C. 紫草
D. 蒲黄
E. 大黄

正确答案：E。大黄

解析：大黄性味苦寒，归脾、胃、大肠、肝、心包经，其功效为泻下攻积，清热泻火，凉血解毒，止血，逐瘀通经，利湿退黄（E对）。栀子的功效为泻火除烦，清热利湿，凉血解毒；外用消肿止痛（A错）。牡丹皮的功效为清热凉血，活血化瘀（B错）。紫草的功效为清热凉血，活血解毒，透疹消斑（C错）。蒲黄的功效为止血，化瘀，利尿通淋（D错）。